下列指标中，目前临床诊断甲型病毒性肝炎采用
A. HAV﹣RNA
B. HAV﹣IgM
C. HAV﹣IgG
D. HAV组织培养分离病毒
E. 狨猴接种分离病毒

正确答案：B。HAV﹣IgM